男性，60岁，因胃溃疡合并多次大出血，行胃大部切除术。术后10天，已进流质饮食，突然出现呕吐，禁食后症状好转，钡餐检查见吻合口延及输出段有较长狭窄，形似漏斗和一细线形的漏斗尾，该病人可选择的治疗措施不包括
A. 胃肠减压
B. 输血
C. 应用皮质激素
D. 胃肠外营养
E. 立即手术

正确答案：E。立即手术

解析：老年男性患者，因胃溃疡合并大出血行胃大部切除术，术后10天进流质饮食时出现呕吐，应考虑为术后胃排空障碍，即术后胃瘫。（七版黄家驷外科学P1425）胃排空障碍常发生于术后最初2周，可能是手术创伤或迷走神经切断后胃运动功能紊乱所致，无机械性梗阻，临床症状常在流质饮食改为半流质时发生，表现为上腹饱胀压迫感、恶心、呕吐，多数病人经胃肠减压（A对）、输液、输血（B对）、应用糖皮质激素（C对）、胃肠外营养（D对）等保守治疗后症状缓解，无需立即手术（E错，为本题正确答案）。